从天然产物中得到的乙酰胆碱酯酶抑制剂是
A. 盐酸美金刚
B. 石杉碱甲
C. 长春西汀
D. 酒石酸利斯的明
E. 盐酸多奈哌齐

正确答案：B。石杉碱甲

解析：本题考查乙酰胆碱酯酶抑制剂的来源。石杉碱甲（B对）系从石杉科植物千层塔中提取的一种生物碱，是强效的胆碱酯酶可逆性抑制剂。